在舌诊中，邪热挟酒毒上壅的舌象为
A. 舌多瘀斑
B. 舌色晦暗
C. 舌脉粗长
D. 舌色青紫
E. 舌紫肿胀

正确答案：E。舌紫肿胀

解析：肿胀舌表现为舌体肿大满嘴，甚至不能闭口，伸出则难以缩回。其成因有三：一是心脾有热，血络热盛而气血上壅，致舌鲜红而肿胀。一是素善饮酒，邪热挟酒毒上壅，致舌紫而肿胀（E对）。一是因中毒而致血液凝滞，致舌青紫晦暗而肿胀。也可因先天舌部血络郁闭，致舌紫儿肿胀。舌有紫色斑点者，可能是瘀血阻滞于局部，或局部血络损伤所致（A错）。舌色晦暗多见于绛舌，绛舌较红舌颜色更深，或略带暗红色，主热盛（B错）。舌下络脉粗胀、分叉，或呈青紫、绛、绛紫、紫黑色，或舌下细小络脉呈暗红色或紫色网络，或舌下络脉曲张如紫色珠子状大小不等的瘀血结节等改变，皆为血瘀的征象。其形成原因可有气滞、寒凝、热郁、痰湿、气虚、阳虚等，需结合其他症状综合分析（C错）。青紫舌主气血瘀滞，由于气血运行不畅，故舌见青紫（D错）。